可引起心脏Q-T间期延长的药物是
A. 克林霉素
B. 磺胺甲噁唑
C. 左氧氟沙星
D. 头孢呋辛
E. 米诺环素

正确答案：C。左氧氟沙星

解析：本题考查药物的不良反应。可引起心脏Q-T间期延长的药物是左氧氟沙星（C对）。左氧氟沙星属于氟喹诺酮类药物，氟喹诺酮类药物可引起心脏Q-T间期延长。克林霉素（A错）不良反应有肝功能异常、肾功能异常。磺胺甲噁唑（B错）所致的严重不良反应虽少见，但可致命，如渗出性多形红斑、剥脱性皮炎、大疱表皮松解萎缩性皮炎、暴发性肝坏死、粒细胞缺乏症、再生障碍性贫血等。头孢呋辛（D错）不良反应有消化系统反应、皮肤反应和头痛等。米诺环素（E错）不良反应有休克和过敏反应、自身免疫性肝炎、超敏综合征等。